药品监督管理部门在药品监督管理过程中为制止违法行为，防止证据损毁，常采用的行政强制措施是
A. 查封扣押财物
B. 冻结存款、汇款
C. 罚款
D. 拘留

正确答案：A。查封扣押财物

解析：本题考查的是行政强制措施。药品监督管理部门在药品监督管理过程中为制止违法行为，防止证据损毁，常采用的行政强制措施是查封扣押财物（A对）。行政强制的概念和原则：行政强制，是指行政机关为了实现预防或制止正在发生或可能发生的违法行为、危险状态以及不利后果，或者为了保全证据、确保案件查处工作的顺利进行等行政目的，而对相对人的人身或财产采取强制性措施的行为，包括行政强制措施和行政强制执行。行政强制的设定和实施应当适当，并应当依照法定的权限、范围、条件和程序。采用非强制手段可以达到行政管理目的的，不得设定和实施行政强制。实施行政强制，应当坚持教育与强制相结合。公民、法人或者其他组织对行政机关实施行政强制，享有陈述权、申辩权；有权依法申请行政复议或者提起行政诉讼；因行政机关违法实施行政强制受到损害的，有权依法要求赔偿。公民、法人或者其他组织因人民法院在强制执行中有违法行为或者扩大强制执行范围受到损害的，有权依法要求赔偿。（二）行政强制措施：行政强制措施，是指行政机关在行政管理过程中，为制止违法行为、防止证据损毁、避免危害发生、控制危险扩大等情形，依法对公民的人身自由实施暂时性限制，或者对公民、法人或者其他组织的财物实施暂时性控制的行为。行政强制措施的种类包括：①限制公民人身自由；②查封场所、设施或者财物；③扣押财物；④冻结存款、汇款（B错）；⑤其他行政强制措施。（三）行政强制执行：行政强制执行，是指行政机关或者行政机关申请人民法院，对不履行行政决定的公民、法人或者其他组织，依法强制履行义务的行为。行政强制执行的方式包括：①加处罚款或者滞纳金；②划拨存款、汇款；③拍卖或者依法处理查封、扣押的场所、设施或者财物；④排除妨碍、恢复原状；⑤代履行；⑥其他强制执行方式。罚款（C错）属于财产罚。财产罚：是指行政主体依法对违法行为人给予的剥夺财产权的处罚形式。财产罚是运用最广泛的一种行政处罚，其形式主要有罚款和没收财物（没收违法所得、没收非法财物等）两种。罚款，是行政主体依法强制违法行为人在一定期限内交纳一定数额货币的一种处罚方式，《药品管理法》中运用相当广泛。没收违法所得、没收非法财物，是行政主体依法将违法行为人的违法所得、违禁物品、违法行为工具等强制收归国有的一种处罚形式。以强制手段剥夺违法行为人的财产权，以此达到惩罚目的。药品行政处罚中的没收内容包括没收非法财物（药品、假药、劣药）、没收违法所得、没收与违法行为有关的其他财物等。拘留（D错）属于人身罚。人身罚：是指特定行政主体限制和剥夺违法行为人人身自由的行政处罚，如行政拘留。《行政处罚法》规定，“限制人身自由的行政处罚，只能由法律设定”。《药品管理法》规定，对生产销售假药和生产销售劣药情节严重的，以及伪造编造许可证件、骗取许可证件等情节恶劣的违法行为，可以由公安机关对相关责任人员处五日至十五日的拘留。